成人急性呼吸窘迫综合征最常见的呼吸特点是
A. 呼吸浅慢
B. 呼吸浅快
C. 呼吸深慢
D. 呼吸不规则
E. 呼吸深快

正确答案：E。呼吸深快

解析：成人急性呼吸综合征即急性呼吸窘迫综合征（ARDS），ARDS其呼吸困难的特点是呼吸深快、费力（E对），病人常感到胸廓紧束、严重憋气，即呼吸窘迫，不能用通常的吸氧疗法改善，亦不能用其他原发心肺疾病（如气胸、肺气肿、肺不张、肺炎、心力衰竭）解释。呼吸浅慢一般见于吗啡、巴比妥类药物和有机磷杀虫药中毒（A错）。呼吸浅快一般见于精神性呼吸困难，临床上一般见于焦虑症、癔症病人（B错）。呼吸深慢一般见于神经源性呼吸困难，临床上一般见于重症颅脑疾病（C错）。呼吸不规则一般见于中枢神经系统疾病，常见如脑炎、脑膜炎等（D错）。